急性毒性是
A. 机体连续多次接触化学物所引起的中毒效应
B. 机体一次大剂量接触化学物后引起快速而猛烈的中毒效应
C. 机体一次大剂量或24小时多次接触外源化学物后所引起的中毒效应，甚至死亡效应
D. 瞬间给予动物一定量化学物后快速出现的中毒效应

正确答案：C。机体一次大剂量或24小时多次接触外源化学物后所引起的中毒效应，甚至死亡效应

解析：本题考查急性毒性。急性毒性指实验动物一次接触或24小时内多次接触一定剂量的某种外源化学物短期内所产生的健康损害作用和致死效应（C对ABD错）。